白果除敛肺平喘外，又能
A. 清肠通便
B. 降气止呕
C. 收涩止带
D. 润肺止咳
E. 宣散风热

正确答案：C。收涩止带